真热假寒证的治法是
A. 以寒治热
B. 以寒治寒
C. 寒者热之
D. 用热远热
E. 用寒远寒

正确答案：B。以寒治寒

解析：本题考查的是反治。真热假寒证的治法是寒因寒用（B对）。反治，又称从治，是指顺从疾病证侯的外在假象而治的治疗法则。反治，适用于临床表现与疾病证候本质不完全一致的病症。反治，主要包括热因热用、寒因寒用、塞因塞用、通因通用四种治法。1.热因热用：热因热用又称“以热治热”，是指针对假热的临床表现，用热性药物来进行治疗。适用于阴寒内盛、格阳于外，反见假热之象的真寒假热证。2.寒因寒用：寒因寒用又称“以寒治寒”，是指针对假寒的临床表现，用寒性药物进行治疗。适用于里热盛极、阳盛格阴，反见假寒之象的真热假寒证。3.塞因塞用：塞因塞用又称“以补开塞”，是指针对闭塞不通的临床表现，用补虚药物进行治疗。适用于因虚而出现闭塞不通假象的真虚假实证。如脾虚腹胀、血虚经闭等。4.通因通用：通因通用又称“以通治通”，是指针对通泄的临床表现，用通利药物进行治疗。适用于因实而出现通利假象的真实假虚证。如热结旁流、湿热淋证、瘀血崩漏等。以寒治热（A错）与寒者热之（C错）属于正治。正治，又称逆治，是指采用方药的性质与疾病的证候性质相反的治疗法则。正治，适用于临床表现与疾病证候本质相一致的病证。常用的治法有寒者热之、热者寒之、虚则补之、实则泻之等。1.寒者热之：寒者热之又称“以热治寒”，是指寒性病证出现寒象，用温热方药进行治疗。如表寒证用辛温解表方药，里寒证用辛热温里方药等。2.热者寒之：热者寒之又称“以寒治热”，是指热性病证出现热象，用寒凉方药进行治疗。如表热证用辛凉解表方药，里热证用苦寒清里方药治疗等。3.虚则补之：虚则补之是指虚损性病证出现虚象，用补益方药进行治疗。如阳虚用温阳方药；阴虚用滋阴方药；气虚用补气方药；血虚用补血方药等。4.实则泻之：实则泻之是指实性病证出现实象，用攻逐邪实的方药进行治疗。如气滞用理气行滞方药，食滞胃脘用消食导滞方药，水饮停留用逐水方药，瘀血用活血化瘀方药等。用热远热（D错）、用寒远寒（E错）属于因时制宜的。因时制宜，是指根据不同季节气候特点，来考虑治疗用药的原则。四时气候的变化，对人体的生理功能、病理变化均产生一定的影响。1.用温远温：前者之“温”，指药性之温；后者之“温”，指气候之温；“远”，即避之、避免之意。下文仿此。春季，气候由温渐热，阳气升发，应避免过用辛温发散药物，以免发泄太过。2.用热远热：夏季，气候炎热，人体腠理疏松，阳气偏盛，应避免过用热性药物，以免耗伤气阴。3.用凉远凉：秋季，阴长阳消，气候转凉，人体腠理致密，避免过用凉性药物，以免伤及阳气。4.用寒远寒：冬季，气候由凉变寒，阴盛阳衰，阳气内敛，应避免过用寒性药物，以防伤阳。